下列抗生素属于β-内酰胺类抗生素的是
A. 青霉素类
B. 氯霉素类
C. 氮基糖苷类
D. 庆大霉素类
E. 四环素类

正确答案：A。青霉素类

解析：本题考查抗菌药物的分类。属于β-内酰胺类抗生素的是青霉素类（A对）。抗菌药物按化学结构分类可分为：①青霉素类；②头孢菌素类；③其他β-内酰胺类，以上3类统称为β-内酰胺类；④氨基糖苷类（C错）；⑤四环素类（E错）；⑥大环内酯类；⑦林可霉素类；⑧磺胺类；⑨喹诺酮类；⑩硝基呋喃类；⑪硝基咪唑类等（BD错）。